抑制腺苷酸环化酶，激活磷酸二酯酶的激素是
A. 胰高血糖素
B. 胰岛素
C. 盐皮质激素
D. 肾上腺素
E. 促性腺激素

正确答案：B。胰岛素